以下哪项疾病绝对不应妊娠
A. 女方患心脏病，但心功能正常
B. 夫妇双方之一患慢性传染病
C. 单纯性卵巢囊肿
D. 子宫肌瘤
E. 女方患肝病肝功不良

正确答案：E。女方患肝病肝功不良

解析：本题考查主要疾病的相关内容。重要脏器的严重疾病：如心脏病、肝炎（肝病肝功能不良）（E对ABCD错）、肺结核、糖尿病、甲状腺功能亢进等严重疾病，是绝对不应妊娠的，因其对婚育均有一定程度的影响，特别是女性患者怀孕后还可能发生不良结局，影响后代健康。婚育医学指导：积极治疗，待疾病控制，身体能够胜任时再怀孕，这样既能保护母体健康，又可避免因用药而影响胎儿发育或致畸。